可以促进尿酸排泄的，肾结石患者禁用的药物是
A. 秋水仙碱
B. 苯溴马隆
C. 非布司他
D. 碳酸氢钠
E. 别嘌醇

正确答案：B。苯溴马隆

解析：本题考查苯溴马隆。苯溴马隆（B对）为促进尿酸排泄药，其促尿酸排泄作用可因水杨酸盐、吡嗪酰胺等拮抗而减弱。